蛋白质分子一定具有
A. α-螺旋
B. β-折叠
C. 三级结构
D. 四级结构
E. 亚基

正确答案：C。三级结构